白术入药部位
A. 入药部位为根
B. 入药部位为根茎
C. 两者均是
D. 两者均不是

正确答案：B。入药部位为根茎

解析：本题考查的是白术的来源。白术入药部位是根茎（B对）。白术：【来源】为菊科植物白术的干燥根茎。入药部位为根（A错）的中药有牛膝、川牛膝、商陆、银柴胡、白芍、赤芍、板蓝根、地榆、苦参、葛根、粉葛、黄芪、西洋参、白芷、当归等。